属于宫颈癌诊断方法的是
A. B型超声波检查
B. 宫颈活组织病理学检查
C. 阴道分泌物常规化验
D. 宫颈细胞检查
E. 阴道镜检查

正确答案：B。宫颈活组织病理学检查

解析：本题考查宫颈癌诊断方法。宫颈细胞学检查是一种简单有效的早期宫颈癌筛查方法，广泛应用于癌症预防普查。宫颈活组织病理学检查是（B对ACDE错）诊断宫颈癌和癌前病变是最可靠和必要的方法。